低钾血症少见于
A. 长期进食不足
B. 持续胃肠减压
C. 碱中毒
D. 急性肾衰竭
E. 大量输入葡萄糖和胰岛素

正确答案：D。急性肾衰竭

解析：急性肾衰竭有起始期、持续期（少尿期）和恢复期（多尿期），少尿期易发生高钾血症，多尿期可引起低钾血症，通常认为急性肾衰竭引起的多为高钾血症，而非低钾血症（D对）。长期进食不足（A错）钾摄入过少、持续胃肠减压（B错）钾丢失过多、碱中毒（C错）与大量输注葡萄糖和胰岛素（E错）会促使血浆中的钾向细胞内转移，均为导致低钾血症的常见原因。